苎麻根除了凉血止血外还能
A. 止痢
B. 利尿
C. 生津
D. 止咳
E. 敛疮

正确答案：B。利尿

解析：本题考查的是苎麻根的功效。苎麻根除了凉血止血外还能利尿（B对）。苎麻根：【功效】凉血止血，清热安胎，利尿，解毒。仙鹤草：【功效】收敛止血，止痢（A错），截疟，解毒，杀虫，补虚。白茅根：【功效】凉血止血，清热生津（C错），利尿通淋。侧柏叶：【功效】凉血止血，祛痰止咳（D错），生发乌发。地榆：【功效】凉血止血，解毒敛疮（E错）。